要直接研究病因与疾病之间的因果关系，最佳、可行的研究设计是
A. 病例系列研究
B. 横断面研究
C. 病例对照研究
D. 队列研究
E. 随机对照试验

正确答案：D。队列研究

解析：本题考查队列研究以及穆勒法则与流行病学研究设计。能研究病因与疾病之间因果关系的是队列研究和随机对照试验，而最佳、可行的研究设计是队列研究（D对ABCE错）。